因局部支气管狭窄所致的呼吸音的附加音是
A. 粗湿啰音
B. 中湿啰音
C. 细湿啰音
D. 捻发音
E. 干啰音

正确答案：E。干啰音

解析：干啰音又称连续性呼吸附加音，是一种持续时间较长的呼吸性附加音。气流通过狭窄的支气管时发生漩涡或气流通过有黏稠分泌物的管腔时冲击黏稠分泌物引起的振动均可产生干啰音。管腔狭窄的原因有支气管黏膜水肿、渗出或增厚，支气管平滑肌痉挛，管腔内肿瘤侵入，异物或分泌物使支气管部分阻塞，支气管外肿瘤或肿大的淋巴结压迫等（E对）。粗湿啰音又称大水泡音。产生于气管、大支气管或空洞内，多出现在吸气早期。见于肺结核空洞、肺水肿、昏迷或濒死的患者，也可见于支气管扩张症。昏迷或濒死的患者因无力将气管内的分泌物咳出，呼吸时可出现大湿啰音，有时不用听诊器都能听到，称为痰鸣音（A错）。中湿啰音又称中水泡音。产生于中等大小的支气管内，多出现于吸气的中期。见于支气管肺炎、支气管炎、肺梗死、肺结核（B错）。细湿啰音又称小水泡音。发生在小支气管或肺泡内，多在吸气终末出现。常见于细支气管炎、支气管肺炎、肺结核早期、肺淤血、肺水肿及肺梗死等（C错）。一般认为捻发音是由未展开的或液体稍增多而互相黏合的肺泡在吸气时被气流冲开所产生的细小爆裂音。持续存在的捻发音为病理性的，见于肺炎早期、肺结核早期、肺淤血、纤维性肺泡炎（D错）。